心脏破裂的典型表现为
A. 低血压，心音消失，无电活动
B. 血压测不到，心音消失，无电活动
C. 低血压，心音正常，有电活动
D. 血压测不到，心音消失，有电活动
E. 低血压，心音正常，无电活动

正确答案：D。血压测不到，心音消失，有电活动

解析：心脏破裂的典型表现为持续性心前区疼痛，可迅速发生循环衰竭、急性心包压塞，心电图呈电-机械分离，即无脉性电活动（有心肌组织电活动，但无有效的机械收缩）。故心脏破裂患者可有电活动。心音是指由心肌收缩、心脏瓣膜关闭和血液撞击心室壁、大动脉壁等引起的振动所产生的声音，心脏破裂患者心音不可能正常。故心脏破裂的典型表现为血压测不到，心音消失，有电活动（D对）等。